位于肺门处
A. 肺淋巴结
B. 支气管肺淋巴结
C. 气管支气管淋巴结
D. 气管旁淋巴结
E. 纵隔淋巴结

正确答案：B。支气管肺淋巴结

解析：支气管肺淋巴结（B对）位于肺门处，又称肺门淋巴结，其输出淋巴管注入气管支气管淋巴结。